关于胃癌扩散转移途径，哪项是不正确的
A. 可转移到左侧锁骨上淋巴结
B. 可转移到脐周淋巴结
C. 可血行转移到肝脏
D. 可种植到盆底
E. 不会转移到卵巢

正确答案：E。不会转移到卵巢

解析：胃癌有四种扩散转移途径：1.直接蔓延至相邻器官2.淋巴结转移 可转移到左锁骨上淋巴结（A对）、脐周淋巴结（B对）3.血行播散 最常转移到肝脏（C对）4.种植转移 常种植于肠壁和盆腔（D对）如卵巢（E错，为本题正确答案）、直肠周围等。